氯丙嗪对下列哪种病症的疗效最好
A. 抑郁症
B. 精神分裂症
C. 焦虑症
D. 精神紧张症
E. 其他精神病

正确答案：B。精神分裂症

解析：本题考查吩噻嗪类药物氯丙嗪。氯丙嗪对精神分裂症（B对）疗效最好。氯丙嗪临床用于治疗各型精神分裂症，能有效地控制症状，尤以阳性症状改善最为明显。此外，也可用于治疗双向障碍的躁狂症状及其他精神病（E错）伴有的兴奋躁动、紧张和妄想等症状。对忧郁症（A错）状及木僵症状的疗效较差。焦虑性神经症（简称焦虑症）（C错）的治疗药物为三环类抗抑郁药。精神紧张症（D错）的治疗药物为盐酸氟西汀。